测孕妇坐骨结节间径7cm时，还应测量
A. 耻骨弓角度
B. 对角径
C. 坐骨棘间径
D. 出口前矢状径
E. 出口后矢状径

正确答案：E。出口后矢状径

解析：测孕妇坐骨结节间径7cm（＜8cm）时，还应测量出口后矢状径（E对）。耻骨弓角度（P147）（A错）是指两手拇指指尖斜着对拢放置在耻骨联合下缘，左右两拇指平放在耻骨降支上，测量所得的两拇指间角度为耻骨弓角度，此角度反映骨盆出口横径的宽度。对角径（P147）（B错）是指骶岬上缘中点到耻骨联合下缘的距离。坐骨棘间径（P148）（C错）是指测量两坐骨棘间径的距离，正常值是10cm，是中骨盆最短的径线，此径线过小会影响分娩过程中胎头的下降。出口前矢状径（P171）（D错）是耻骨联合下缘中点至坐骨结节间径中点间的距离。